既是淋巴器官又是内分泌器官的是
A. 脾
B. 淋巴结
C. 扁桃体
D. 胸腺
E. 胰

正确答案：D。胸腺

解析：胸腺(D对）是中枢淋巴器官又是内分泌器官，可以分泌胸腺素和促胸腺生成素。